十二指肠大乳头位于十二指肠
A. 水平部前壁
B. 升部前壁
C. 降部后内侧壁
D. 降部后外侧壁
E. 水平部后壁

正确答案：C。降部后内侧壁

解析：十二指肠乳头（主要指十二指肠大乳头）是十二指肠降部中、下1/3交界处的后内侧壁（C对）局部黏膜形成的圆形隆起，是胆总管和胰管的共同开口处，距中切牙约75cm。在大乳头上方约1cm处，常可见十二指肠小乳头，为副胰管的开口处。